流行性感冒的病原体是
A. 流行性感冒细菌
B. 流行性感冒病毒
C. 流行性感冒支原体
D. 脑膜炎双球菌
E. 以上均不对

正确答案：B。流行性感冒病毒